关于慢性肾小球肾炎临床诊断不正确的是
A. 蛋白尿和（或）血尿，伴有水肿者
B. 蛋白尿和（或）血尿，伴有高血压者
C. 单纯性蛋白尿，尿蛋白大于1g/d者，除外继发性肾小球肾炎和遗传性肾小球肾炎
D. 单纯性蛋白尿，尿蛋白大于1.5g/d者，除外继发性肾小球肾炎和遗传性肾小球肾炎
E. 蛋白尿和（或）血尿，伴有肾功能不全者

正确答案：D。单纯性蛋白尿，尿蛋白大于1.5g/d者，除外继发性肾小球肾炎和遗传性肾小球肾炎

解析：诊断指标：蛋白尿和（或）血尿，伴有水肿、高血压、肾功能不全至少一种情况者；若为单纯性蛋白尿，尿蛋白大于1g/d者，在除外继发性肾小球肾炎和遗传性肾小球肾炎后，即可诊断为慢性肾小球肾炎。掌握“慢性肾小球肾炎、肾病综合征”知识点。